下牙槽神经阻滞麻醉如针头污染可造成的间隙感染为
A. 眶下间隙
B. 颞下间隙
C. 翼颌间隙
D. 咬肌间隙
E. 颌下间隙

正确答案：C。翼颌间隙

解析：本题考查口腔颌面部间隙感染。下牙槽神经阻滞麻醉如针头污染可造成的间隙感染为翼颌间隙（C对）。翼颌间隙即翼下颌间隙，位于下颌支内侧骨壁与翼内肌外侧面之间。此间隙中有从颅底卵圆孔出颅之下颌神经分支及下牙槽动、静脉穿过，借蜂窝组织与相邻的颞下、颞、颊、下颌下、舌下、咽旁、咬肌等间隙相通；经颅底血管、神经还可通入颅内。眶下间隙（A错）：【感染来源】多来自上颌尖牙、第一前磨牙和上颌切牙的根尖化脓性炎症和牙槽脓肿；此外，可因上颌骨骨髓炎的脓液穿破骨膜，或上唇底部与鼻侧的化脓性炎症扩散至眶下间隙引起。颞下间隙（B错）：【感染来源】可从相邻间隙，如翼下颌间隙等感染扩散而来；也可因上颌结节、卵圆孔、圆孔阻滞麻醉时带入感染；或由上颌磨牙的根尖周感染或拔牙后感染引起。咬肌间隙（D错）：【感染来源】主要来自下颌智齿冠周炎，下颌磨牙的根尖周炎、牙槽脓肿，亦可因相邻间隙如颞下间隙感染的扩散，偶有因化脓性腮腺炎波及者。颌下间隙（E错）：【感染来源】多见于下颌智齿冠周炎、下颌后牙根尖周炎、牙槽脓肿等牙源性感染或下颌下淋巴结炎的扩散。化脓性下颌下腺炎有时亦可继发下颌下间隙感染。